在氯霉素滴眼剂处方中,下列物质的作用是：羟苯甲酯
A. 渗透压调节剂
B. 抑菌剂
C. 抗氧剂
D. 金属离子络合剂
E. pH调节剂

正确答案：B。抑菌剂

解析：本题考查滴眼剂的附加剂。羟苯甲酯为抑菌剂（B错）；渗透压调节剂（A错）为氯化钠；抗氧剂（C错）有焦亚硫酸钠、亚硫酸氢钠、亚硫酸钠等；金属离子络合剂（D错）为乙二胺四乙酸二钠；pH调节剂（E错）有磷酸盐缓冲液、硼酸缓冲液等。